女，60岁。宫颈癌行子宫切除术后3天，晨起时突发左小腿疼痛，左足不能着地踏平，行走时疼痛加重。查体：左小腿肿胀，深压痛，足背动脉搏动存在。首选的检查为
A. 同位素骨扫描
B. 下肢CT
C. 下肢X线平片
D. 下肢MRI
E. 下肢超声多普勒

正确答案：E。下肢超声多普勒

解析：老年女性患者，宫颈癌行子宫切除术（术后血液处于高凝状态，术后卧床导致下肢静脉血流缓慢，易形成静脉血栓）后3天，晨起突发左小腿疼痛，左足不能着地踏平，行走时疼痛加重（下肢深静脉血栓的典型临床表现）。查体：左小腿肿胀（提示静脉回流障碍），深压痛，足背动脉搏动存在（提示动脉通畅）。综合该患者的病史及体查，诊断考虑下肢深静脉血栓形成，首选的检查为下肢超声多普勒（E对），可明确下肢深静脉阻塞的部位。同位素骨扫描（A错）主要用于诊断恶性肿瘤骨转移。下肢CT（B错）、X线平片（C错）、MRI（D错）对下肢深静脉血栓形成的诊断价值不大，一般不用。